目前最佳的牙种植材料是
A. 陶瓷
B. 钛
C. 玻璃碳
D. 树脂
E. 不锈钢

正确答案：B。钛

解析：钛及钛合金由于具有良好的生物学性能和理想的力学性能，成为目前应用最广、最受青睐的种植体金属材料。掌握“牙种植术概论”知识点。